元气耗损和功能减退，脏腑功能低下，抗病能力下降的病机是
A. 气虚
B. 气脱
C. 血虚
D. 津亏
E. 气陷

正确答案：A。气虚

解析：本题考查气虚的临床表现，属于理解记忆内容。元气耗损为气虚的一种表现形式，又因卫气虚弱可导致卫气护卫人体，避免外邪入侵的作用减弱，所固“元气耗损和功能减退，脏腑功能低下，抗病能力下降”的表现符合气虚的临床表现（A对）。气脱：气脱，即气不内守，大量向外亡失，以致生命机能突然衰竭的一种病理状 态（B错）。血虚，是指血液不足，血的濡养功能减退的病理状态（C错）。津亏，即津液不足，是指津液在数量上的亏少，进而导致内则脏腑，外而孔窍、皮毛，失于濡 润、滋养而产生一系列干燥枯涩的病理状态（D错）。气陷：气陷，指气的上升不足或下降太过，以气虚升举无力而下陷为特征的一种 病理状态（E错）。